吸烟人群戒烟技能掌握率的变化属于
A. 瞬间效果评价
B. 即时效果评价
C. 近期效果评价
D. 中期效果评价
E. 远期效果评价

正确答案：C。近期效果评价